能量的需要，为小儿特有的所需是
A. 基础代谢
B. 活动
C. 食物的特殊动力作用
D. 排泄损失能量
E. 生长发育

正确答案：E。生长发育

解析：儿童总能量消耗包括基础代谢（A错）、食物的特殊动力作用（C错）、活动（B错）消耗、排泄损失能量（D错）、生长发育。组织生长合成消耗的能量为儿童特有，生长所需能量和儿童生长速度成正比，即随年龄增长逐渐减少（E对）。